有关脊髓丘脑侧束的描述,正确的是
A. 起始细胞在脊神经节内
B. 位于脊髓小脑前束的外侧
C. 主要由不交叉的纤维组成
D. 发纤维至小脑
E. 终止于丘脑腹后外侧核

正确答案：E。终止于丘脑腹后外侧核

解析：脊髓丘脑侧束位于脊髓的外侧索（A错），发纤维至丘脑（D错），终止于丘脑腹后外侧核（E对）。